神经细胞动作电位上升支是由于
A. K⁺内流
B. Cl⁻内流
C. Na⁺内流
D. K⁺外流
E. Ca²⁺内流

正确答案：C。Na⁺内流